既可内服又可外用的剂型有
A. 锭剂
B. 钉剂
C. 散剂
D. 膜剂
E. 棒剂

正确答案：A、C、D。锭剂；散剂；膜剂

解析：本题考查的是制剂类型。既可内服又可外用的剂型有锭剂（A对）、散剂（C对）、膜剂（D对）。锭剂供内服，可吞服或研细以水或黄酒化服，外用多是研细用醋或酒调敷，也可作嗅入或外搽药用。散剂按医疗用途可分为内服散剂和外用散剂。膜剂供口服或黏膜用。钉剂（B错）一般供外科插入，用于治疗痔、瘘管及溃疡等。棒剂（E错）可直接用于皮肤或黏膜，起腐蚀、收敛等作用，多用于眼科。